急性肾功能衰竭伴高钾血症患者，心率40次/分。应首先采取的治疗措施是
A. 静脉点滴5%碳酸氢钠
B. 静脉点滴10%葡萄糖+胰岛素
C. 口服降钾树脂
D. 静脉注射10%葡萄糖酸钙
E. 血液透析

正确答案：E。血液透析

解析：急性肾功能衰竭伴高钾血症患者，心率40次/分，说明患者已经出现心律失常，这是高钾血症导致的，若不立即采取有效降钾措施，患者可能发生心跳骤停。因此应立即采取降钾措施，首选血液透析（E对），其是最有效最迅速的降钾措施。静脉点滴5%碳酸氢钠（A错）、静脉点滴10%葡萄糖+胰岛素（B错）、口服降钾树脂（C错）及静脉注射10%葡萄糖酸钙（D错）均可降钾，但其降钾速度均不如血液透析，因此均非首选。